开门于下鼻道的是
A. 筛窦前群
B. 鼻泪管
C. 额窦
D. 上颌窦
E. 无

正确答案：B。鼻泪管

解析：鼻泪管开口于下鼻道（B对）。筛窦前、中群开口于中鼻道（A错）。额窦开口于中鼻道前部的筛漏斗处（C错）。上颌窦的开口通入中鼻道半月裂孔（D错）。